以下药品书写单位的描述，不正确的是
A. 丸剂以粒为单位
B. 颗粒剂以袋为单位
C. 溶液剂以支、瓶为单位
D. 软膏以支、盒为单位
E. 注射剂以支、瓶为单位

正确答案：A。丸剂以粒为单位

解析：片剂、丸剂、胶囊剂、颗粒剂分别以片、丸、粒、袋为单位；溶液剂以支、瓶为单位；软膏及乳膏剂以支、盒为单位；注射剂以支、瓶为单位，应当注明含量；中药饮片以剂为单位。掌握“处方管理概述及一般规定、处方权”知识点。